患者小便点滴不畅，烦渴欲饮，咽干咳嗽，舌苔薄黄，脉数。治疗应首选
A. 八正散
B. 导赤散
C. 沉香散
D. 代抵当丸
E. 清肺饮

正确答案：E。清肺饮

解析：患者小便点滴不畅，故诊断为癃闭；肺热壅盛，失于肃降，不能通调水道，下输膀胱，故小便点滴不畅；肺热上壅，气逆不降，故咳嗽；烦渴欲饮，咽干，舌苔薄黄，脉数，均是里热内郁之征，故其证候为肺热壅盛证，治以清泄肺热，通利水道，代表方为清肺饮（E对）。八正散，其功用为清热利湿，利尿通淋，可用于癃闭之膀胱湿热证（A错）。导赤散，其功用为清心利水养阴，适用于治疗心经火热证(B错)。沉香散，其功用为疏肝达气，活血行气，可用于治疗癃闭之肝郁气滞证（C错）。代抵当丸，其功用为活血化瘀散结，可用于治疗癃闭之浊瘀阻塞证（D错）。